艾叶和香附配伍后的功效是
A. 收敛止血，生肌敛疮
B. 清热泻火，凉血止血
C. 疏肝理气，散寒暖宫，调经止痛
D. 活血止痛，化瘀止血
E. 养血止血，散寒暖宫

正确答案：C。疏肝理气，散寒暖宫，调经止痛

解析：本题考查的是艾叶的配伍。艾叶和香附配伍后的功效是疏肝理气，散寒暖宫，调经止痛（C对）。艾叶：【配伍】艾叶配阿胶：艾叶性温，功善散寒暖宫、温经止血，并能调经安胎；阿胶性平，功能养血止血。两药相配，既养血止血，又散寒暖宫（E错）调经，治崩漏下血属血虚有寒之证。艾叶配香附：艾叶性温，功善散寒暖宫、温经止血；香附性平，功善疏肝理气、调经止痛。两药相配，既疏肝理气，又散寒暖宫、调经止痛，治肝郁气滞、宫寒痛经。白及配海螵蛸：白及微寒黏涩，功能收敛止血、生肌；海螵蛸微温燥涩，功能收敛止血、制酸止痛、敛疮。两药相配，功能收敛止血、生肌敛疮（A错），治胃、十二指肠溃疡之吐血、便血效佳。黄芩：【性能特点】本品苦寒清泄而燥，主入肺与大肠经，兼入胆、脾、胃经。既清热泻火而凉血止血（B错）、安胎、解热毒，又燥湿、除湿毒而解湿热毒。为治湿热火毒之要药，广泛用于湿热火毒之病证。与黄连相比，其清热燥湿力较弱，作用偏于上焦肺及大肠，善清上焦湿热，除肺与大肠之火。五灵脂：【功效】活血止痛，化瘀止血（D错），解蛇虫毒。